在城乡集市贸易市场，药品零售企业设点销售的药品超出了批准经营的药品范围，根据《中华人民共和国药品管理法实施条例》，可以给予该企业的处罚有
A. 警告，责令限期改正
B. 责令停业整顿
C. 依法予以取缔，没收药品和违法所得
D. 处违法销售药品货值金额二倍以上五倍以下的罚款
E. 构成犯罪的，依法追究刑事责任

正确答案：C、E。依法予以取缔，没收药品和违法所得；构成犯罪的，依法追究刑事责任

解析：本题考查无证生产、经营药品的法律责任。在城乡集市贸易市场，药品零售企业设点销售的药品超出了批准经营的药品范围，根据《中华人民共和国药品管理法实施条例》，可以给予该企业的处罚有依法予以取缔，没收药品和违法所得（C对）；构成犯罪的，依法追究刑事责任（E对）。无证生产、经营药品的法律责任：根据《药品管理法》第一百一十五条的规定，未取得药品生产许可证、药品经营许可证或者医疗机构制剂许可证生产、销售药品的，责令关闭，没收违法生产、销售的药品和违法所得，并处违法生产、销售的药品（包括已售出和未售出的药品，下同）货值金额十五倍以上三十倍以下的罚款；货值金额不足十万元的，按十万元计算。其他按照无证生产、经营处罚的情形，包括：①未经批准，擅自在城乡集市贸易市场设点销售药品或者在城乡集市贸易市场设点销售的药品超出批准经营的药品范围的。参见《药品管理法实施条例》第65条。②个人设置的门诊部、诊所等医疗机构向患者提供的药品超出规定的范围和品种的。参见《药品管理法实施条例》第67条。③药品生产企业、药品经营企业和医疗机构变更药品生产、经营许可事项，应当办理变更登记手续而未办理的，由原发证部门给予警告，责令限期补办变更登记手续；逾期不补办的，宣布其《药品生产许可证》《药品经营许可证》和《医疗机构制剂许可证》无效；仍从事药品生产经营活动的，依照《药品管理法》第一百一十五条的规定处罚。参见《药品管理法实施条例》第74条。